下列哪项不属于伤寒的临床特点
A. 发热
B. 皮疹
C. 白细胞升高
D. 脾大
E. 表情淡漠

正确答案：C。白细胞升高

解析：伤寒常见的临床表现有持续发热（A对）、表情淡漠（E对）、相对脉缓、玫瑰皮疹（B对）、肝脾肿大（D对）、血中白细胞降低（C错，为本题正确答案）。